属于医疗保健机构提供婚前卫生指导的是
A. 性卫生知识教育
B. 遗传病诊察
C. 传染病诊察
D. 心理健康指导
E. 对生育保健提供医学意见

正确答案：A。性卫生知识教育

解析：本题考查医疗保健机构提供婚前的卫生指导。医疗保健机构提供婚前的卫生指导需进行性卫生知识教育（A对BCDE错），因男女双方缺乏必要的性卫生知识，必须指导保持外阴部的清洁卫生，做到每天清洗并更换内裤。最好在性生活前双方都清洗外阴部，避免因性生活诱发生殖道感染等。